芍药汤与白头翁汤的组成中均含有的药物是
A. 黄芩
B. 黄连
C. 黄柏
D. 大黄
E. 秦皮

正确答案：B。黄连

解析：本题考查白头翁汤与芍药汤的药物组成。白头翁汤与芍药汤均为清热剂，芍药汤由芍药、槟郎、大黄、黄芩、黄连、当归、官桂、甘草、木香构成，白头翁汤由白头翁、黄连 、黄柏、秦皮构成，两者均含有的药物为黄连（B对）。黄芩仅为芍药汤的药物组成（A错）。黄柏仅为白头翁汤的药物组成（C错）。大黄仅为芍药汤的药物组成（D错）。秦皮仅为白头翁汤的药物组成（E错）。趣记：白头翁汤，白头翁秦二黄 [寓意]     白头翁擒二黄 。芍药汤，芩香连当官，大草药榔 [寓意]     秦香莲当官，大吵要郎。